判断药物不良反应是否出现的一条必需的原则是
A. 与已知的药物不良反应相符
B. 停药后反应停止
C. 重新用药反应再现
D. 时间顺序合理

正确答案：D。时间顺序合理

解析：本题考查病因推断的标准。在流行病学研究中，时间顺序（D对ABC错）是必须提供的依据，是判断药物不良反应是否出现的一条必需的原则，它寓于研究设计之中。